抗菌药物的细菌耐药率超过一定的百分比时，慎重经验用药，该百分比是
A. 0.5
B. 0.2
C. 0.1
D. 0.4
E. 0.3

正确答案：D。0.4

解析：主要目标细菌耐药率超过40%（D对）的抗菌药物，应当慎重经验用药。